导致眼球震颤毒性反应的苯妥英钠的血浆浓度为
A. 1～2㎍/ml
B. 5～10㎍/ml
C. 10～20㎍/ml
D. 20～40㎍/ml
E. ＞200㎍/ml

正确答案：D。20～40㎍/ml

解析：本题考查苯妥英钠。苯妥英钠治疗血浆浓度为10-20µg/ml（ABC错），血浆浓度超过20µg/ml（D对）时会出现眼球震颤，超过40µg/ml（E错）会出现严重的不良反应。